某女，4岁。平日身体瘦弱，不思进食，食不知味，面色少华，神倦乏力，多汗，大便溏薄，多见不消化食物；舌淡苔薄白，脉缓无力。宜选用的基础方剂是
A. 异功散
B. 养胃增液汤
C. 不换金正气散
D. 保和丸
E. 良附丸

正确答案：A。异功散

解析：本题考查的是厌食的辨证论治。某女，4岁。平日身体瘦弱，不思进食，食不知味，面色少华，神倦乏力，多汗，大便溏薄，多见不消化食物；舌淡苔薄白，脉缓无力。宜选用的基础方剂是异功散（A对）。厌食，是指脾胃受纳运化功能失常所致的疾病，以较长时间的厌恶进食，食量减少为临床特征。西医学的厌食症可参考此内容辨证论治。（一）脾失健运证：【症状】食欲不振，厌恶进食，食而乏味，或伴胸脘痞闷，嗳气泛恶，偶尔多食则脘腹饱胀，大便不调，形体尚可，精神如常。舌淡红，苔薄白或薄腻，脉尚有力。【方剂应用】基础方剂为不换金正气散（陈皮、苍术、厚朴、草果、半夏、甘草、藿香、生姜、大枣）加减（C错）。（二）脾胃气虚证：【症状】不思进食，食不知味，神倦多汗，大便溏薄夹不消化食物，面色少华，形体偏瘦，肢倦乏力。舌淡，苔薄白，脉缓无力。【方剂应用】基础方剂为异功散（人参、白术、茯苓、陈皮、甘草）加减。（三）脾胃阴虚证：【症状】不思进食，食少饮多，皮肤失润，大便偏干，小便短黄，甚或烦躁少寐，手足心热。舌红少津，苔少或花剥，脉细数。【方剂应用】基础方剂为养胃增液汤（石斛、乌梅、沙参、玉竹、白芍、甘草）加减（B错）。胃痛饮食伤胃证：【症状】胃脘疼痛，胀满拒按，嗳腐恶食，或吐不消化食物，吐后或矢气后痛减，大便不爽。舌淡红，苔厚腻，脉滑。【方剂应用】基础方剂为保和丸（D错）（山楂、神曲、茯苓、半夏、莱菔子、陈皮、连翘、麦芽）加减。胃痛寒邪客胃证：【症状】胃痛暴作，喜温恶寒，得温痛减，口和不渴，或喜热饮。舌淡，苔薄白，脉弦紧。【方剂应用】基础方剂为良附丸（高良姜、香附）加减（E错）。